属于碳青霉烯类的β-内酰胺类抗生素是
A. 氨曲南
B. 亚胺培南
C. 舒巴坦钠
D. 克拉维酸钾
E. 替莫西林

正确答案：B。亚胺培南

解析：本题考查碳青霉烯类的β-内酰胺类抗生素。属于碳青霉烯类的β-内酰胺类抗生素是亚胺培南（B对）。氨曲南（A错）属于单环β-内酰胺类。舒巴坦钠（C错）属于青霉烷砜类。克拉维酸钾（D错）属于氧青霉烷类。替莫西林（E错）为半合成青霉素。